女性，48岁。发作性剑突下及右上腹绞痛3天，伴有寒战，半年前有过类似发作史。查体：体温39℃，脉搏110次/分，血压140/85mmHg。血常规检查：WBC12×10⁹/L，N80%，神志清楚，皮肤巩膜轻度黄染，右肋缘下扪及肿大的胆囊，轻度触痛。后该病人皮肤巩膜黄染加重，体温升高至40℃，脉搏130次/分，血压90/60mmHg，神志不清。此时最有效的治疗是
A. 胆总管切开减压T管引流
B. 联合应用大剂量抗生素
C. 补液恢复血容量
D. 给予糖皮质激素
E. 物理降温，支持治疗

正确答案：A。胆总管切开减压T管引流

解析：患者中年女性，右上腹绞痛、体温39℃（中等度热，正常值36～37℃）、皮肤、巩膜轻度黄染（黄疸）（Charcot三联征，胆管炎典型表现），后病情发展，体温40度（高热），黄疸加重，血压90/60mmHg、脉搏130次/分（休克指数为：1.44，在1.0～1.5之间，提示休克），神志不清。患者已表现为Reynolds五联征（急性梗阻性化脓性胆管炎的典型表现），最可能的诊断为急性梗阻性化脓性胆管炎。急性梗阻性化脓性胆管炎的发病基础是胆道梗阻及细菌感染。如果在疾病发展过程中，胆道梗阻不能解除，胆管内细菌引起的感染得不到控制，将会危及患者生命。胆总管切开減压、T管引流（A对）对患者最有效。联合应用大剂量抗生素（B错）、补液恢复血容量（C错）、给予糖皮质激素（D错）、物理降温，支持治疗（E错）均为一般性辅助治疗，单独应用仅能暂时改善症状，均不是最有效的治疗方式。